以上哪项属于H2受体阻滞剂的药物是
A. 阿托品
B. 6542017U3ZXY2017U3-2
C. 法莫替丁
D. 硫糖铝
E. 消炎痛

正确答案：C。法莫替丁

解析：法莫替丁为H2受体拮抗药，可抑制胃酸分泌，用于急性胃黏膜病变、胃泌素瘤、反流性食管炎等（C对）；阿托品为抗胆碱药，用于各种内脏绞痛，如胃肠绞痛及膀胱刺激症状（A错）；654-2的通用名为山莨菪碱，是一种解痉镇痛药，临床常用于胃肠道的解痉止痛治疗（B错）；硫糖铝为细胞保护药，有抑制胃蛋白酶和吸附胆盐的作用，主要用于治疗消化性溃疡和慢性胃炎（D错）；消炎痛是非甾体抗炎药，用于各类关节炎、软组织损伤、各种疼痛等（E错）。